肺循环淤血表现
A. 肝颈静脉回流征阳性
B. 颈静脉搏动
C. 双肺底对称细湿啰音
D. 多浆膜腔积液
E. 下肢水肿

正确答案：C。双肺底对称细湿啰音

解析：双肺底对称细湿啰音（C对）是肺循环淤血的表现，由于肺毛细血管压增高，液体渗出到肺泡而出现。肝颈静脉回流征阳性（A错）颈静脉搏动（B错）多浆膜腔积液（D错）下肢水肿（E错）是体循环淤血的表现。